某男性患者行全口义齿修复后，全口义齿初戴时的医嘱中，不正确的是
A. 饭后需要清洗
B. 睡觉时可以戴用义齿
C. 不戴时浸泡在冷水中
D. 出现疼痛，及时到医院复诊
E. 有异物感、恶心、发音不清等

正确答案：B。睡觉时可以戴用义齿

解析：全口义齿佩戴者在夜间睡觉或者休息时，是不能佩带义齿的，以免引起危险。掌握“全口义齿初戴”知识点。